一患者，左上后牙颊侧牙龈肿胀，疼痛2天。检查：左上56间颊侧呈卵圆形膨隆，波动感（+），若诊断为急性牙周脓肿，与牙槽脓肿鉴别诊断，下面哪一项不正确
A. （牙合）创伤
B. 牙周袋的存在
C. 是否有龈下牙石
D. X线片
E. 叩痛程度

正确答案：A。（牙合）创伤

解析：本题考查牙周脓肿与牙槽脓肿的鉴别。若诊断为急性牙周脓肿，与牙槽脓肿鉴别诊断不正确的是（牙合）创伤（A错，为本题的正确答案）。（牙合）创伤只是牙周病的局部刺激因素，单纯短期的（牙合）创伤不会引起牙周袋，也不会引起或加重牙龈的炎症。牙槽脓肿一般无牙周袋，牙周脓肿可见深牙周袋（B对）。菌斑是导致导致牙周炎症的始动因子，牙石为牙周疾病的局部刺激因素，牙周脓肿是牙周病的伴发病变（C对）。牙周脓肿X线片表现为牙槽嵴有破坏，可有骨下袋，牙槽脓肿X线片表现为根尖周可有骨质破坏，也可无（D对）。牙周脓肿叩痛相对较轻，牙槽脓肿叩痛很重（E对）。